女，40岁。头痛3个月，加重伴间断性呕吐、抽搐、视物模糊1个月。查体：右上肢可见2个活动良好的椭圆形结节，眼底检查有视神经乳头水肿。最可能的诊断是
A. 癫痫
B. 隐球菌性脑膜炎
C. 脑肿瘤
D. 囊尾蚴病
E. 结核性脑膜炎

正确答案：D。囊尾蚴病

解析：患者有明显头痛，伴有呕吐、抽搐、视物模糊等颅内高压的症状，从右上肢可见2个活动良好的结节，怀疑为囊尾蚴导致的皮下软组织包囊，则患者最可能的诊断为囊尾蚴病（D对）。癫痫（A错）临床表现具有发作性、短暂性、重复性和刻板性的特点。隐球菌性脑膜炎（B错）起病隐匿，进展缓慢，早期有不规则低热，间歇性头痛，明显脑膜刺激征，不会出现皮下结节。结核性脑膜炎（E错）患者可有明显结核中毒表现，查体可见脑膜刺激征，不会出现皮下结节。脑肿瘤（C错）分为良性肿瘤和恶性肿瘤，良性肿瘤生长缓慢，局限在脑内，可引起颅内高压的症状；恶性肿瘤生长迅速，可发生转移，也可引起颅内高压症状，威胁生命。